关于逆行性牙髓炎的临床表现不正确的是
A. 可探及深的牙周袋
B. 严重的根分叉病变
C. 可有叩痛
D. 温度测验牙髓反应强烈
E. 可探及深龋洞

正确答案：E。可探及深龋洞

解析：发生逆行性牙髓炎时不可探及深龋洞，经由牙周感染牙髓的途径称为逆行性感染，所引起的牙髓炎称为逆行性牙髓炎。掌握“残髓炎及逆行性牙髓炎”知识点。